男性，50岁。因胃癌伴重度贫血入院，既往体健，无输血史。术前化验Hb56/L。为纠正贫血下列最合适的输血治疗是
A. 输全血
B. 输浓缩红细胞
C. 输洗涤红细胞
D. 输去白细胞的红细胞
E. 输冷冻红细胞

正确答案：B。输浓缩红细胞

解析：患者胃癌伴重度贫血（成年男性Hb应≥120g/L，30～59g/L为重度贫血）已明确诊断，无输血史，为纠正贫血，最合适的输血治疗应为输浓缩红细胞（B对）。2000年卫生部输血指南建议：Hb＜70g/L可输入浓缩红细胞。每110～120ml浓缩红细胞中即包含200ml全血中的全部红细胞，可快速纠正各种急、慢性贫血。由于全血中成分多，一方面易发生输血反应，另一方面会造成浪费，故临床上一般不主张输全血（A错）。洗涤红细胞（P25）（C错）是指去除了绝大多数的血浆、有功能白细胞及血小板、肝炎病毒、抗A、B抗体之后剩余的血液，其主要成分也为红细胞，主要用于对白细胞凝集素有发热反应者、肾功能不全不能耐受库存血高血钾者。去白细胞的红细胞（D错）是指去除90%白细胞之后剩下的血液，主要用于多次输血后产生白细胞抗体者、预期需要长期或反复输血者。冰冻红细胞（E错）不含血浆，可保存3年，主要作为稀有血型或自身红细胞的储存方式。